下列不是生理性甲状腺肿大体征的是
A. 轻度肿大
B. 表面光滑
C. 无任何症状
D. 可闻及连续性血管杂音
E. 质地柔软

正确答案：D。可闻及连续性血管杂音

解析：生理性甲状腺肿大临床上一般无明显症状（C对），甲状腺常呈轻、中度肿大（A对），表面光滑（B对），质地柔软（E对）。连续性血管杂音（D错，为本题正确答案）为Graves病（弥漫性毒性甲状腺肿）的体征，即为病理性甲状腺肿的体征。